多皱缩成团，主根长圆锥形，淡棕黄色。叶基生，灰绿色，叶片展平后呈披针形或卵状披针形，蒴果椭圆形或3裂的药材是
A. 大蓟
B. 蒲公英
C. 半枝莲
D. 紫花地丁
E. 车前草

正确答案：D。紫花地丁

解析：本题考查的是紫花地丁的性状鉴别。多皱缩成团，主根长圆锥形，淡棕黄色。叶基生，灰绿色，叶片展平后呈披针形或卵状披针形，蒴果椭圆形或3裂的药材是紫花地丁（D对）。紫花地丁：【性状鉴别】药材多皱缩成团，主根长圆锥形；淡黄棕色，有细纵皱纹。叶基生，灰绿色，展平后叶片呈披针形或卵状披针形；先端钝，基部截形或稍心形，边缘具钝锯齿，两面有毛；叶柄细，上部具明显狭翅。蒴果椭圆形或3裂，种子多数，淡棕色。气微，味微苦而稍黏。大蓟（A错）：【性状鉴别】药材茎呈圆柱形；表面绿褐色或棕褐色，有数条纵棱，被丝状毛；断面灰白色，髓部疏松或中空。叶皱缩，多破碎，完整叶片展平后呈倒披针形或倒卵状椭圆形，羽状深裂，边缘具不等长的针刺；上表面灰绿色或黄棕色，下表面色较浅，两面均具灰白色丝状毛。头状花序顶生，球形或椭圆形，总苞黄褐色，羽状冠毛灰白色。气微，味淡。蒲公英（B错）：【性状鉴别】药材呈皱缩卷曲的团块。根呈圆锥形，多弯曲；表面棕褐色，抽皱；根头部有棕褐色或黄白色的茸毛，有的已脱落。叶基生，多皱缩破碎，完整叶片呈倒披针形，绿褐色或暗灰绿色，先端尖或钝，边缘浅裂或羽状分裂，基部渐狭，下延呈柄状，下表面主脉明显；花茎一至数条，每条顶生头状花序，总苞片多层，内面一层较长，花冠黄褐色或淡黄白色。有的可见多数具白色冠毛的长椭圆形瘦果。气微，味微苦。半枝莲（C错）：【性状鉴别】药材无毛或花轴上疏被毛。根纤细。茎丛生，较细，方柱形；表面暗紫色或棕绿色；叶对生，有短柄；叶片多皱缩，展平后呈三角状卵形或披针形；先端钝，基部宽楔形，全缘或有少数不明显的钝齿；上表面暗绿色，下表面灰绿色。花单生于茎枝上部叶腋，花萼裂片钝或较圆；花冠二唇形，棕黄色或浅蓝紫色，被毛。果实扁球形，浅棕色。气微，味微苦。车前草（E错）：【性状鉴别】药材车前根丛生，须状。叶基生，具长柄；叶片皱缩，展平后呈卵状椭圆形或宽卵形；表面灰绿色或污绿色，具明显弧形脉；先端钝或短尖，基部宽楔形，全缘或有不规则波状浅齿。穗状花序数条，花茎长。蒴果盖裂，萼宿存。气微香，味微苦。